不属于目前能依法进行卫生监督的公共场所是
A. 宾馆
B. 音乐厅
C. 证券交易厅
D. 候诊室
E. 游泳场

正确答案：C。证券交易厅

解析：本题考查能依法进行卫生监督的公共场所。根据国务院发布的《公共场所卫生管理条例》规定，目前能依法进行卫生监督的公共场所共7类28种，包括：1.住宿与交际场所（8种）：宾馆（A对）、饭馆、旅馆、招待所、车马店、咖啡馆、酒吧、茶座；2.洗浴与美容场所（3种）：公共浴室、理发店、美容店；3.文化娱乐场所（5种）：影剧院、录像厅（室）、游艺厅（室）、舞厅、音乐厅（B对）；4.体育与游乐场所(3种）：体育场（馆）、游泳场（馆）（E对）、公园；5.文化交流场所(4种）：展览馆、博物馆、美术馆、图书馆；6.购物场所（2种）：商场（店）、书店；7.就诊与交通场所（3种）：候诊室（D对）、候车（机、船）室、公共交通工具（汽车、火车、飞机和轮船）。证券交易厅（C错，为本题正确答案）不属于目前能依法进行卫生监督的公共场所。